随机选择5所幼儿园小班儿童进行某疫苗的预防效果观察，随访3年结果表明85%的免疫接种者未发生该病，由此可以认为
A. 该疫苗预防效果欠佳，仍有15%儿童生病
B. 该疫苗预防有效，因可保护85%儿童生病
C. 不能下结论，因为3年观察时间不够
D. 不能下结论，因为未设对照组

正确答案：D。不能下结论，因为未设对照组

解析：本题考查队列研究的实际应用。队列研究通过直接观察某因素不同暴露状况人群的结局来探讨该因素与所观察结局的关系，对照组时队列研究的重要因素。本题试验对注射疫苗的暴露组进行随访，而没有对不接种儿童进行追踪观察，无对照组存在（D对ABC错），因此试验不够严谨，无法得出有意义的结论。